选择人工后牙时主要要考虑什么因素，除了
A. 近远中宽度
B. 颊舌径宽度
C. （牙合）面解剖形态
D. 人工牙的质地
E. 人工牙的品牌

正确答案：E。人工牙的品牌

解析：本题考查选牙-人工后牙的选择。人工牙的品牌（E错，为本题的正确答案）对人工牙的选择并没有实质性的影响。后牙的主要作用是咀嚼，选择与牙槽嵴状况相适应的（牙合）面形态（C对）、近远中宽度（A对）和颊舌向宽度（B对），人工牙有塑料牙和瓷牙两种质地（D对），选择时要综合考虑。